庆大霉素易引起
A. 药源性急性胃溃疡
B. 药源性肝病
C. 药源性耳聋
D. 药源性心血管损害
E. 药源性血管神经性水肿

正确答案：C。药源性耳聋

解析：本题考查药源性疾病。引起药源性耳聋（C对）的有：氨基糖苷类：如庆大霉素；非甾体抗炎药；高效利尿药；抗疟药；其它类；引起药源性肝病（B错）的有四环素类；引起药源性心血管系统损害（D错）有：地高辛、麻黄碱、奎尼丁等；引起药源性血管神经性水肿（E错）的有：卡托普利、依那普利等。